下列关于抑癌基因的叙述，正确的是
A. 最早发现的是Rb基因
B. 能抑制细胞过度生长
C. 突变后可导致肿瘤形成
D. 可诱导细胞凋亡
E. 以上均是

正确答案：E。以上均是

解析：本题考查抑癌基因。抑癌基因编码产物的功能主要有诱导细胞分化、维持基因组稳定、触发或诱导细胞凋亡（D对）等，总体上抑癌基因对生长起着负调控作用，能抑制细胞的过度生长（B对）。若肿瘤抑制基因发生突变，则不能表达正常产物，或者其编码蛋白产物的活性受到抑制，使细胞增殖调控失衡，导致肿瘤发生（C对）；最早发现的抑癌基因为Rb基因（A对）。（ABCD均对，故E为本题的正确答案）。